某校六年级（12岁年龄组）300名学生中恒牙有龋、失、补的人数为180人，未治龋齿数为328个，因龋失牙数为3个，因龋充填牙数为69个。若该年级学生随机分成两组，一组用氟水漱口，另一组用自来水漱口，观察氟水漱口的效果，该研究被称为
A. 常规资料分析
B. 横断面调查
C. 病例对照研究
D. 群组研究
E. 流行病学实验

正确答案：E。流行病学实验

解析：本题考查实验流行病学。若该年级学生随机分成两组，一组用氟水漱口，另一组用自来水漱口，观察氟水漱口的效果，该研究被称为流行病学实验（E对）。口腔流行病学研究包括描述流行病学、分析流行病学和实验流行病学。（1）描述流行病学包括：①横断面研究（B错），又称现况调查，调查目标人群中某种疾病或现象在某一特定时间的情况；②纵向研究又称疾病监测，即研究疾病或某种情况在一个人群中随着时间推移的自然动态变化；③常规资料分析（A错）又称历史资料分析，即对已有资料或者疾病检测记录做分析或总结。（2）分析流行病学研究包括病例对照研究（C错）主要用于探讨病因或相关因素对疾病发生的影响；群组研究（D错）又称队列研究，将特定人群按其是否暴露于某种因素分为暴露组与非暴露组，追踪观察一定时间，比较两组的发病率，以检验该因素与某疾病病因的假设。（3）实验流行病学又称流行病学实验，是指在研究者的控制下对人群采取某项干预措施或消除某种因素以观察其对人群疾病发生或健康状态的影响。